临床上脊柱骨折常表现为第1腰椎体被压碎向后方突出，这时受波及的是何脊髓节段
A. 马尾
B. 终丝
C. L1~2脊髓
D. L3~5脊髓
E. S1~5脊髓

正确答案：E。S1~5脊髓

解析：根据脊髓节段于椎骨的对应顺序可知，骶髓、尾髓节段约平对第1腰椎，当第1腰椎体被压碎向后方突出时可波及S1~5脊髓（E对）及尾髓。